在八脉交会穴中，与内关穴相通的奇经是
A. 阴维脉
B. 带脉
C. 冲脉
D. 任脉
E. 阴跷脉

正确答案：A。阴维脉

解析：八脉交会穴是古人在临床实践中总结出的可治疗奇经八脉病证的8个腧穴，这8个腧穴分别与相应的奇经八脉经气相通。在临床上当奇经八脉出现相关的疾病时，可取对应的八脉交会穴来治疗。阴维脉（A对）通于内关，带脉（B错）通于足临泣，冲脉（C错）通于公孙。任脉（D错）通于列缺。阴跷脉（E错）通于照海。【八脉交会八穴歌】公孙冲脉胃心胸，内关阴维下总同。临泣胆经连带脉，阳维目锐外关逢。后溪督脉内眦颈，申脉阳跷络亦通。列缺任脉行肺系，阴跷照海膈喉咙。